既降肺气，又散风热的药物是
A. 半夏
B. 旋覆花
C. 白前
D. 前胡
E. 桑白皮

正确答案：D。前胡

解析：前胡的功效为降气化痰，散风清热。可用于治疗痰热咳喘，咯痰黄稠；风热咳嗽痰多；既可降肺气又宣散风热（D对）。半夏的功效为燥湿化痰，降逆止呕，消痞散结。治疗湿痰寒痰，咳喘痰多，痰饮眩悸，风痰眩晕，痰厥头痛；胃气上逆，呕吐反胃（A错）。旋覆花的功效为降气，消痰，行水，止呕。治疗风寒咳嗽，痰饮蓄结，胸膈痞闷，喘咳痰多；呕吐噫气，心下痞硬（B错）。白前的功效为降气，祛痰，止咳。治疗肺气壅实，咳嗽痰多，胸满喘急（C错）。桑白皮的功效为泻肺平喘，利水消肿。治疗肺热喘咳；水肿胀满尿少，面目肌肤浮肿（E错）。